关于环境污染的描述不正确的是
A. 进入环境的污染物量超过了环境的自净能力
B. 进入环境的污染物造成了环境质量下降和恶化
C. 进入环境的污染物直接或间接影响到人体健康
D. 严重的环境污染可导致公害
E. 进入环境的污染物量超过了环境质量或卫生标准

正确答案：E。进入环境的污染物量超过了环境质量或卫生标准

解析：本题考查环境污染的相关内容。环境污染是指进入环境的污染物的量超过了环境的自净（A对）能力（E错，为本题正确答案），造成环境质量下降和恶化（B对），直接或间接影响到人体健康（C对）。环境污染物（因素）种类繁多，按其属性通常分为化学性、物理性和生物性三类。严重的环境污染可导致公害（D对）。